脏腑中有“主液”作用的是
A. 脾
B. 胃
C. 大肠
D. 小肠
E. 三焦

正确答案：D。小肠

解析：小肠主液指小肠在吸收谷精的同时，吸收了大量津液的生理机能。小肠吸收的津液与谷精合为水谷之精，由脾气转输到全身，其中部分津液经三焦下渗膀胱，成为尿液生成之源（D对）。脾具有主运化、主统血的生理机能（A错）；胃具有主受纳、腐熟水谷的生理机能（B错）；大肠具有主传化糟粕与主津的生理机能（D错）；三焦具有主疏通水道，运行津液的生理机能（E错）。